牙周病最有效的预防措施有
A. 正确刷牙、定期洁治，养成良好的口腔卫生习惯
B. 盐水漱口，使用药物牙膏
C. 改变偏侧咀嚼习惯
D. 定期调（牙合），去除创伤因素
E. 牙龈翻瓣手术

正确答案：A。正确刷牙、定期洁治，养成良好的口腔卫生习惯

解析：本题考查牙周病的预防。牙周病最有效的预防措施有正确刷牙、定期洁治，养成良好的口腔卫生习惯（A对）。因为菌斑是牙周病的始动因子，必须重视菌斑的控制，每天持之以恒地彻底清除或减少菌斑的形成，盐水漱口，使用药物牙膏（B错）,改变偏侧咀嚼习惯（C错）、定期调（牙合），去除创伤因素（D错）可以预防牙周病，但控制菌斑才是最有效的措施。只有经过基础治疗才能进行手术治疗（E错）。